作用时间属于超短效的制剂是
A. 赖脯胰岛素
B. 甘精胰岛素
C. 普通胰岛素
D. 精蛋白锌胰岛素
E. 低精蛋白锌胰岛素

正确答案：A。赖脯胰岛素

解析：本题考查胰岛素制剂的种类及特点。超短效胰岛素有门冬胰岛素、赖脯胰岛素（A对）。甘精胰岛素（B错）属于超长效胰岛素。普通胰岛素（C错）属于短效胰岛素。精蛋白锌胰岛素（D错）属于长效胰岛素。低精蛋白锌胰岛素（E错）属于中效胰岛素。